健胃消食药的服药时间是
A. 饭前服
B. 多次分服
C. 空腹时服
D. 饭后服
E. 腹痛时服

正确答案：D。饭后服

解析：饭后服的药物多是消食健胃药或对胃肠有刺激的药物以及病在胸膈以上者（D对）。饭前服（A错）多是病在胸腹以下，如胃、肝、肾等脏疾患。多次分服（B错）适用于服药呕吐者。驱虫药、攻下药、补益药一般应在空腹时服，峻下逐水药晨起空腹时服（C错）。